低容量性低钠血症也可称为
A. 高渗性脱水
B. 等渗性脱水
C. 低渗性脱水
D. 原发性脱水
E. 水中毒

正确答案：C。低渗性脱水

解析：低容量性低钠血症也称低渗性脱水（C对），特点是失钠多于失水。高渗性脱水又称低容量性高钠血症（A错），特点是失水多于失钠。水中毒又称高容量性低钠血症（E错）。